英国医生队列研究显示，吸烟与肺癌的相对危险度高达14。如果完全根除吸烟，在潜在吸烟者中可以预防90%以上的肺癌病例。据此事实，以下论述错误的是
A. 吸烟只是肺癌的一个组分病因
B. 吸烟是肺癌主要充分病因的组分病因
C. 吸烟是肺癌的必要病因
D. 吸烟几乎相当于肺癌的一个必要病因
E. 吸烟既不是肺癌的必要病因，也不是肺癌的充分病因

正确答案：C。吸烟是肺癌的必要病因

解析：本题考查必要病因。必要病因是一个疾病发生必需的组分病因，是该疾病所有充分病因都需要的组分病因；若该病因不存在，疾病就不会发生，因此所有病人都具有该病因。因此吸烟不是肺癌的必要病因（C错，为本题正确答案）。据此事实，可知吸烟只是肺癌的一个组分病因（A对）；吸烟是肺癌主要充分病因的组分病因（B对）；吸烟几乎相当于肺癌的一个必要病因（D对）；吸烟既不是肺癌的必要病因，也不是肺癌的充分病因（E对）。